知觉的基本特征中不正确的是
A. 知觉的选择性
B. 知觉的整体性
C. 知觉的相对性
D. 知觉的理解性
E. 知觉的恒常性

正确答案：C。知觉的相对性

解析：知觉的基本特征：（1）知觉的选择性；（2）知觉的整体性；（3）知觉的理解性；（4）知觉的恒常性。掌握“认识过程”知识点。